血瘀证可见
A. 刺痛拒按，固定不移，舌暗，脉涩
B. 气短疲乏，脘腹坠胀，舌淡，脉弱
C. 胸胁胀闷窜痛，时轻时重，脉弦
D. 面色淡白，口唇爪甲色淡，舌淡，脉细
E. 少气懒言，疲乏无力，自汗，舌淡，脉虚

正确答案：A。刺痛拒按，固定不移，舌暗，脉涩

解析：血瘀证因血行瘀阻，不通则痛，故刺痛拒按，固定不移，舌暗，脉涩（A对）。气短疲乏，脘腹坠胀，舌淡，脉弱（B错）见于气陷证。胸胁胀闷窜痛，时轻时重，脉弦（C错）见于气滞证。面色淡白，口唇爪甲色淡，舌淡，脉细（D错）见于血虚证。少气懒言，疲乏无力，自汗，舌淡，脉虚（E错）见于气不固证。